发出分支营养脊髓的动脉是
A. 椎动脉
B. 小脑下前动脉
C. 基底动脉
D. 大脑中动脉
E. 大脑前动脉

正确答案：A。椎动脉

解析：营养脊髓的动脉有两个来源，即椎动脉（发出脊髓前动脉和脊髓后动脉两条分支）（A对）和节段性动脉。